对阈剂量描述错误的是
A. 指毒物引起受试对象中少数个体出现某种最轻微的异常改变所需要的最低剂量
B. 与毒物一次接触所得的阈剂量为急性阈剂量
C. 长期反复多次接触毒物所得的阈剂量为慢性阈剂量
D. 毒物的急性阈剂量比慢性阈剂量要低

正确答案：D。毒物的急性阈剂量比慢性阈剂量要低

解析：本题考查阈剂量的相关内容。阈剂量是指毒物引起受试对象中少数个体出现某种最轻微的异常改变所需要的最低剂量（A对）。与毒物一次接触所得的阈剂量为急性阈剂量（B对）。长期反复多次接触毒物所得的阈剂量为慢性阈剂量（C对）。毒物的急性阈剂量比慢性阈剂量要高（D错，为本题正确答案）。